流行性出血热多尿早期尿量为
A. 少于400mL
B. 少于1000mL
C. 超过1500mL
D. 超过2000mL
E. 超过3000mL

正确答案：D。超过2000mL

解析：流行性出血热多尿早期每日尿量超过2000mL（D对），氮质血症无明显改善，症状仍重。流行性出血热少尿期主要表现为少尿（24 小时尿量少于400mL）（A错）或无尿（24小时尿量少于100mL），可引起尿毒症、酸中毒、水和电解质紊乱、高血容量综合征和肺水肿等。流行性出血热多尿后期每日尿量超过 3000mL（E错），并逐日增加。